防止粮谷类发热霉变生虫，应将贮存粮谷的水分含量控制在
A. 8%～10%
B. 12%～14%
C. 15%～20%
D. 17%～22%
E. 20%～25%

正确答案：B。12%～14%